男性，20岁，右大腿刀刺伤18小时，刀口处红肿，有渗出液，目前最适当的治疗措施是
A. 清创缝合
B. 抗生素治疗
C. 理疗
D. 清理伤口后换药
E. 局部固定

正确答案：D。清理伤口后换药

解析：本例患者刀口处有红肿、渗液，说明伤口已感染，最适当的治疗措施是清理伤口后放置引流以及换药（D对）。清创缝合（A错）一般适用于伤后8小时以内，或者24小时以内无明显感染的开放性伤口。抗生素治疗（B错）、理疗（C错）、局部固定（E错）对于处理当前急性开放性伤口不能起到及时有效的作用。